能诱导免疫耐受的抗原称为
A. 免疫体
B. 免疫原
C. 耐受原
D. 抗原诱生
E. 免疫应答

正确答案：C。耐受原

解析：免疫耐受是指抗原特异性的免疫无应答。对某种抗原产生免疫耐受的个体，对其他抗原可保持正常的免疫应答能力。免疫耐受是一种特殊形式的免疫应答，它由抗原诱生，具有特异性和记忆性。免疫耐受不同于免疫抑制，后者是一种抗原非特异的免疫不应答或低应答状态。能诱导免疫耐受的抗原称为耐受原。掌握“免疫耐受”知识点。